人格核心是
A. 气质
B. 能力
C. 性格
D. 需要
E. 动机

正确答案：C。性格